乙类传染病中，采取甲类传染病的预防控制措施的疾病是
A. 艾滋病、人感染高致病性禽流感
B. 艾滋病、狂犬病
C. 艾滋病、肺炭疽
D. 传染性非典型肺炎、肺炭疽
E. 传染性非典型肺炎、人感染高致病禽流感

正确答案：D。传染性非典型肺炎、肺炭疽

解析：本题考查采取甲类传染病的预防控制措施的乙类传染病。传染性非典型肺炎、肺炭疽（D对ABCE错）属于乙类传染病，但采取甲类传染病的预防控制措施。